关于氯丙嗪的应用，哪项错误
A. 人工冬眠疗法
B. 精神分裂症
C. 药物引起的呕吐
D. 晕动病引起的呕吐
E. 躁狂症

正确答案：D。晕动病引起的呕吐